化学名为4-（2-氨基乙基）-1、2-苯二酚盐酸盐的药物是
B. 盐酸多巴酚丁胺
C. 盐酸异丙肾上腺素
D. 盐酸麻黄碱
E. 盐酸多巴胺

正确答案：E。盐酸多巴胺

解析：本题考查药物的化学名。化学名为4-（2-氨基乙基）-1、2-苯二酚盐酸盐的药物是盐酸多巴胺（E对）。盐酸多巴胺的化学名是4-（2-氨基乙基）-1，2-苯二酚盐酸盐。盐酸伪麻黄碱（A错）的化学名是[S-（R*，R*）]-a-1[1-（甲氨基）乙基]-苯甲醇盐酸盐。盐酸多巴酚丁胺（B错）的化学名是4-[２-[[１-甲基-3-（4-羟苯基）丙基]氨基]乙基]-1,2-苯二酚盐酸盐。盐酸异丙肾上腺素（C错）的化学名是4-（（2-异丙氨基-1-羟基）乙基）-1，2-苯二酚盐酸盐。盐酸麻黄碱（D错）的化学名是（1R，2S）-2-甲氨基-苯丙烷-1-醇盐酸盐。